在以下的菌种中，能够造成灵长类动物的实验性龋的细菌是
A. 唾液链球菌
B. 变形链球菌
C. 轻链球菌
D. 血链球菌
E. 酵母菌

正确答案：B。变形链球菌

解析：变形链球菌：经过反复研究证实，变异链球菌可以造成啮齿类动物的和灵长类动物实验性龋，同时也有证据表明该菌与人类龋病密切相关。掌握“龋病概述”知识点。